关于结核分歧杆菌的生物学性状描述不正确的是
A. 抗酸染色阳性，呈红色
B. 在罗氏培养基上的菌落粗糙，可呈菜花状
C. 生长缓慢，18～24h繁殖一代
D. 耐热耐紫外线
E. 专性需氧菌

正确答案：D。耐热耐紫外线

解析：本题考查结核分歧杆菌的生物学性状。结核分枝杆菌的脂类含量高，对某些理化因子的抵抗力较强，但是其对湿热、紫外线、乙醇的抵抗力弱（D错，为本题的正确答案）。结核分歧杆菌抗酸染色阳性，呈红色（A对）；结核分枝杆菌为专性需氧菌（E对），营养要求高，生长缓慢，约18～24小时繁殖一代（C对），接种后培养3～4周才出现肉眼可见的菌落。在罗氏培养基上的菌落粗糙、干燥、坚硬,表面呈颗粒状、乳酪色或黄色，形似菜花样（B对）。